胃癌血行转移，首先转移到
A. 肝脏
B. 肺脏
C. 骨骼
D. 脑部
E. 卵巢

正确答案：A。肝脏

解析：胃癌转移方式分为直接蔓延、淋巴结转移、血行播散及种植转移。胃癌血行转移最常转移到肝脏（A对），其次是肺（B错）、腹膜及肾上腺，也可转移到肾、脑（D错）、骨髓（C错）等。转移到卵巢（E错）为胃癌的种植转移，称Krukenberg瘤。